酸雨是指降水的pH小于
A. 6.5
B. 5.6
C. 4.5
D. 3
E. 2

正确答案：B。5.6

解析：本题考查酸雨的pH。酸雨是指降水的pH小于5.6（B对ACDE错）。